以下哪种药物被称为灭滴灵
A. 氟康唑
B. 甲硝唑
C. 利巴韦林
D. 异烟肼
E. 氯丙嗪

正确答案：B。甲硝唑

解析：甲硝唑，又称为灭滴灵，属硝基咪唑类药物。掌握“磺胺类及甲硝唑”知识点。